水净化过程中，混凝沉淀的原理为
A. 水解＋电中和＋吸附
B. 压缩双电层＋电中和＋水解
C. 压缩双电层＋吸附＋架桥
D. 压缩双电层＋电中和＋吸附架桥
E. 水解＋吸附架桥＋压缩双电层

正确答案：D。压缩双电层＋电中和＋吸附架桥

解析：本题考查混凝沉淀的原理。天然水中的细小颗粒，特别是胶体微粒，难以自然沉淀，是水混浊的主要根源。因此需加入混凝剂进行混凝沉淀，才能加以去除，此过程称为混凝沉淀。其原理为：压缩双电层＋电中和＋吸附架桥（D对ABCE错）。